三叉神经中最大的分支神经是
A. 眼神经
B. 上颌神经
C. 下颌神经
D. 下牙槽神经
E. 舌神经

正确答案：C。下颌神经

解析：眼神经为感觉神经，上颌神经为感觉神经，下颌神经为混合性神经，是三叉神经中最大的分支。掌握“三叉神经的分支与分布”知识点。